流行性腮腺炎儿童期最常见的并发症是
A. 肺炎
B. 脑膜脑炎
C. 心肌炎
D. 急性肾炎
E. 关节炎

正确答案：B。脑膜脑炎

解析：流行性腮腺炎的并发症包括脑膜脑炎、生殖器并发症和胰腺炎等，其中脑膜脑炎（B对）较为常见，一般发生在腮腺炎发病后4～5天，个别患儿脑膜炎先于腮腺炎。临床主要表现及脑脊液改变与其他病毒性脑炎相似。